属于感染性心内膜炎主要诊断标准的是
A. 发热，体温≥38℃
B. 细菌性动脉瘤
C. 原有心脏瓣膜病
D. 超声心动图发现赘生物
E. Osler结节

正确答案：D。超声心动图发现赘生物

解析：感染性心内膜炎为心脏内膜表面的微生物感染，一般因细菌、真菌或其他微生物循血行途径直接感染心脏瓣膜、心室壁内膜或邻近大动脉内膜，伴赘生物形成。诊断主要标准为获得血培养或影像学阳性证据，如经超声心动图发现瓣膜表面赘生物等（D对）。有易患因素如心脏瓣膜病史（C错）、体温≧38℃（A错），细菌性动脉瘤（B错）、免疫性征象如Osler结节（E错）等均作为诊断次要标准，有助于诊断感染性心内膜炎，诊断感染性心内膜炎需要满足2项主要标准，或1项主要标准+3项次要标准，或5项次要标准。